修复体牙体预备的固位形不包括
A. 箱形固位
B. 鸠尾固位
C. 倒凹固位
D. 钉洞固位
E. 沟形固位

正确答案：C。倒凹固位

解析：本题考查牙体缺损修复体常用的固位形。倒凹固位（C错，为本题的正确答案）是充填修复的固位形，而修复体的牙体预备不能有倒凹，否则将无法就位。修复体牙体预备的固位形包括环抱固位形即箱形固位（A对）、鸠尾固位（B对）、钉洞固位（D对）、沟形固位（E对）。